关于结核性淋巴结炎的描述，错误的是
A. 常见于年老、体弱者
B. 淋巴结中央可有干酪样坏死
C. 所形成的脓肿称为冷脓肿
D. 轻者仅有淋巴结肿大而无全身症状
E. 可双侧发生

正确答案：A。常见于年老、体弱者

解析：本题考查结核性淋巴结炎。结核性淋巴结炎常见于儿童及青年（A错，为本题的正确答案）；病变继续发展，淋巴结中央可有干酪样坏死（B对）；炎症波及周围组织可形成冷脓肿（C对）；轻者仅有淋巴结肿大而无全身症状（D对）；颈部淋巴结结核可发生于一侧或双侧（E对），脊副淋巴结为其好发部位。